能正反馈激活自身分泌的胃液成分是
A. 内因子
B. 碳酸氢盐
C. 盐酸
D. 胃蛋白酶
E. 黏液

正确答案：D。胃蛋白酶

解析：胃蛋白酶（D对）能正反馈激活自身分泌的胃液成分胃蛋白酶原。胃蛋白酶原进入胃腔后，在HCl作用下，转变成有活性的胃蛋白酶，已被激活的胃蛋白酶对胃蛋白酶原也有激活作用（正反馈）。内因子（A错）可以促进维生素B₁₂的吸收。HCO₃⁻（B错）与胃黏膜表面的黏液（E错）联合形成黏液-碳酸氢盐屏障，可以有效地保护胃黏膜免受胃内盐酸和胃蛋白酶的损伤。盐酸（C错）能反馈抑制自身分泌的胃液。